疟疾潜伏期的长短与以下哪种没有关系
A. 疟原虫种株的生物特性
B. 机体免疫力
C. 感染疟原虫的方式
D. 感染疟原虫的种类数
E. 血型

正确答案：E。血型